根据《中华人民共和国药品管理法》，属于假药的药品包括
A. 国务院药品监督管理部门规定禁止使用的药品
B. 未经批准生产、进口的药品
C. 微生物限度超标的药品
D. 所标明的适应症或者功能主治超出规定范围时药品
E. 夸大宣传疗效的药品

正确答案：A、B、D。国务院药品监督管理部门规定禁止使用的药品；未经批准生产、进口的药品；所标明的适应症或者功能主治超出规定范围时药品

解析：本题考查假药的界定。根据《中华人民共和国药品管理法》，属于假药的药品包括国务院药品监督管理部门规定禁止使用的药品（A对）；未经批准生产、进口的药品（B对）；所标明的适应症或者功能主治超出规定范围时药品（D对）。假药的界定：《药品管理法》第九十八条第一款、第二款规定，禁止生产（包括配制，下同）、销售、使用假药。有下列情形之一的，为假药：①药品所含成分与国家药品标准规定的成分不符；②以非药品冒充药品或者以他种药品冒充此种药品；③变质的药品；④药品所标明的适应症或者功能主治超出规定范围。